可用于增加难溶性药物的溶解度的是
A. β-环糊精
B. 液状石蜡
C. 羊毛脂
D. 七氟丙烷
E. 硬脂醇

正确答案：A。β-环糊精

解析：本题考查增加难溶性药物的溶解度的方法。药物与β-环糊精（A对）形成包合物，可提高其溶解度。β-环糊精为水溶性环糊精衍生物，可增加药物的溶解度。液体石蜡（B错）为液体制剂中常用的非极性溶剂。羊毛脂（C错）是W/O型乳膏剂常用的乳化剂。七氟丙烷（D错）可作为气雾剂的抛射剂。硬脂醇（E错）为溶蚀性骨架材料。